实脾散的功效是
A. 利水渗湿，温阳化气
B. 温阳健脾，行气利水
C. 解表化湿，理气和中
D. 温阳利水
E. 温中散寒，行气散满

正确答案：B。温阳健脾，行气利水

解析：实脾散主治脾肾阳虚，水气内停之阴水，功用是温阳健脾，行气利水。为治疗脾肾阳虚水肿之常用方（B对）。